阴阳皆消皆长所体现的阴阳关系是
A. 消长平衡
B. 互根互用
C. 对立制约
D. 阴阳交感
E. 阴阳转化

正确答案：B。互根互用

解析：阴阳消长的根本原因，在于阴阳之间对立制约与互藏互根关系的变化。由阴阳对立制约关系变化主要表现为阴阳双方互为消，即此长彼消，或此消彼长（C错）；由阴阳互藏互根关系变化主要表现为阴阳双方的同消同长，即此长彼长，或此消彼消（B对）。阴阳同消同长是阴阳相互依存关系表现出的运动变化，但只是阴阳消长平衡的表现形式之一（A错）。阴阳交感，指阴阳二气在运动中相互感应而交合的相互作用（D错）。阴阳转化，指事物的阴阳属性，在一定条件下可以向其相反的方向转化，即属阳的事物可以转化为属阴的事物，属阴的事物可以转化为属阳的事物。阴阳互藏互根是阴阳转化的内在根据（E错）。